关于淋巴结下列说法正确的是
A. 无浅深之分
B. 与淋巴管不相连
C. 凹侧有淋巴结门
D. 门处有输人淋巴管
E. 无

正确答案：C。凹侧有淋巴结门

解析：淋巴结按照所在位置分为浅淋巴结和深淋巴结（A错），位于浅筋膜内的称为浅淋巴结，位于深筋膜内的称为深淋巴结。淋巴结一侧凸隆一侧凹陷，凹侧有淋巴结门（C对）。淋巴结凸侧连接数条输入淋巴管，凹侧即淋巴结门连接有输出淋巴管（BD错）。